低渗性脱水的补液原则是
A. 补充等渗液
B. 补水为主，适当补钠
C. 补偏低渗(1/2或2/3张）液
D. 补充水分以降低血钠
E. 限制水分摄入，对重症或急性患者，还应给予高渗盐水

正确答案：A。补充等渗液

解析：补充等渗液（A对）应用于低渗性脱水的补液治疗。高渗性脱水时实际上也缺钠，应补水为主，适当补钠（B错）。等渗性脱水时应补偏低渗液（C错）。高钠血症时可适当补充水分以降低血钠（D错）。限制水分摄入，对重症或急性患者给予高渗盐水（E错）的补液方法适用于高容量性低钠血症。